噻嗪类利尿药初期的降压机制为
A. 降低血管壁细胞内Ca²⁺的含量
B. 降低血管壁细胞内Na⁺的含量
C. 降低血管壁对缩血管物质的反应性
D. 排Na⁺利尿，降低细胞外液和血容量
E. 诱导动脉壁产生扩张血管物质

正确答案：D。排Na⁺利尿，降低细胞外液和血容量